下述关于舌神经与下颌下腺导管的鉴别叙述中，哪项是错误的
A. 舌神经下方连于下颌下神经节，通过该节，再以节后纤维与下颌下腺相连
B. 下颌下腺导管直接发自下颌下腺深部
C. 在舌骨舌肌表面，舌神经位于下颌下腺导管上方
D. 若将下颌舌骨肌向前拉开，可见舌神经自外上钩绕下颌下腺导管，经其下方转至其内侧和上方
E. 舌神经较下颌下腺导管细而略扁，且坚韧

正确答案：E。舌神经较下颌下腺导管细而略扁，且坚韧

解析：舌神经与下颌下腺导管关系密，从解剖关系上可作以下鉴别：①联系：舌神经连于下颌下神经节，导管则直接发自下颌下腺；②位置：在舌骨舌肌表面，舌神经位于导管的上方；③形态：舌神经比下颌下腺导管粗而略扁，且坚韧。掌握“颈部分区、颈筋膜层次及下颌下三角解剖特点”知识点。